患者男，60岁，急性广泛前壁心肌梗死2天，晕厥2次，心室率40次/分，率齐，心电图示Ⅲ度房室传导阻滞。治疗首选的措施是
A. 阿托品
B. 溴本辛
C. 麻黄素
D. 人工心脏起搏器
E. 异丙肾上腺素

正确答案：D。人工心脏起搏器

解析：患者发生急性广泛前壁心肌梗死，心电图示Ⅲ度房室传导阻滞，首选措施为安装人工心脏起搏器（D对）。阿托品用于缓解内脏绞痛，如胃肠痉挛引起的疼痛、肾绞痛、胆绞痛（A错）。溴本辛用于胃及十二指肠溃疡、胃酸过多、膀胱刺激症等的治疗（B错）。麻黄素用于预防支气管哮喘发作和缓解轻度哮喘发作，用于蛛网膜下腔麻醉或硬膜外麻醉引起的低血压及慢性低血压症（C错）。异丙肾上腺素静脉用于完全性房室传导阻滞、心脏骤停（E错）。